肠结核最常见的病变部位是
A. 横结肠
B. 降结肠
C. 回盲部
D. 直肠及乙状结肠
E. 升结肠

正确答案：C。回盲部

解析：肠结核由结核分枝杆菌引起，该菌易侵犯淋巴组织，而回盲部淋巴组织丰富，并且含有结核杆菌的肠内容物在回盲部停留较久，增加了局部黏膜的感染机会，所以肠结核病变主要位于回盲部（C对）。另外，肠结核也可累及结肠（ABE错）和直肠。直肠和乙状结肠（D错）是溃疡性结肠炎好发部位（P373）。升结肠（E错）为阿米巴肠病的好发部位。